下颌正颌手术可能损伤的神经是
A. 下牙槽神经
B. 舌神经
C. 颊神经
D. 咬肌神经
E. 颏神经

正确答案：A。下牙槽神经

解析：本题考查正颌外科的术后并发症。下颌正颌手术可能损伤的神经是下牙槽神经（A对）。正颌外科手术视野狭窄，口腔颌面部神经血管丰富，手术时可能发生周围神经损伤等并发症。正颌手术可能损伤三叉神经分支包括下牙槽神经、舌神经（B错）、颊神经（C错）、咬肌神经（D错）及下牙槽神经的终末分支颏神经（E错），甚至损伤面神经，但下颌正颌手术最可能损伤下牙槽神经，颏成形术可能损伤颏神经。